耳屏前形成的皮肤盲管可能是由于
A. 第一鳃沟发育异常
B. 第三鳃弓发育异常
C. 第三鳃沟发育异常
D. 第四鳃弓发育异常
E. 面突发育异常

正确答案：A。第一鳃沟发育异常

解析：本题考查鳃弓及咽囊的发育。耳屏前形成的皮肤盲管可能是由于第一鳃沟发育异常（A对）。第一鳃沟和第一、第二鳃弓发育异常时，可在耳屏前方形成皮肤的狭窄盲管或点状凹陷。多种致畸因子可影响面突的成长和发育，使其生长停止或减缓，导致面突不能如期联合而形成面部畸形，即可导致面突发育异常（E错）。